贝尔麻痹与中枢性面神经麻痹的鉴别要点是
A. 患侧口角下垂，健侧向上歪斜
B. 患侧鼻唇沟消失
C. 患侧眼睑闭合不全
D. 患侧前额皱纹消失，不能蹙眉
E. 不能鼓腮，吹气功能障碍

正确答案：D。患侧前额皱纹消失，不能蹙眉

解析：本题考查贝尔麻痹与中枢性面神经麻痹的鉴别要点。由于面神经核上部的细胞接受两侧皮质脑干束的纤维，其轴突组成面神经的运动纤维，支配同侧脸裂以上的表情肌；面神经核下部的细胞则只接受对侧皮质脑干束的纤维，其轴突组成面神经的运动纤维，支配同侧脸裂以下的表情肌。贝尔麻痹（周围性面神经麻痹）是核下瘫，即病损在面神经核以下，则患侧全部表情肌瘫痪包括患侧前额皱纹消失，不能蹙眉（D对）。中枢性面神经麻痹是核上瘫，即病损位于面神经核以上至大脑皮层之间，则患侧脸裂以下的表情肌瘫痪，但不影响闭眼、皱额。贝尔麻痹与中枢性面神经麻痹都可出现的表现为患侧口角下垂，健侧向上歪斜（A错）；患侧鼻唇沟消失（B错）；患侧眼睑闭合不全（C错）；不能鼓腮，吹气功能障碍（E错）。